与2，6-二氯靛酚反应使颜色消失的是
A. 维生素B₁（盐酸硫胺）
B. 维生素C
C. 两者均能
D. 两者均不能

正确答案：B。维生素C

解析：本题考查常用的药品鉴别方法。与2，6-二氯靛酚反应使颜色消失的是维生素C（B对）。维生素C分子中含有连二烯醇结构，具有较强的还原性，可使二氯靛酚钠试液还原并发生颜色改变。维生素B₁不具有较强的还原性，因而不能使二氯靛酚钠试液还原（ACD错）。